关于氢氧化铝叙述错误的是
A. 中和胃酸的作用强而持久
B. 可引起便秘
C. 可产生CO气体
D. 可引起骨软化
E. 影响四环素、地高辛吸收

正确答案：C。可产生CO气体

解析：氢氧化铝属于无机弱碱类抗酸药，口服后能中和胃酸，抗酸作用强，起效缓慢，作用持久（A对），抑制胃蛋白酶活性，降低或消除胃酸、胃蛋白酶对胃、十二指肠黏膜的侵蚀和对溃疡面的刺激，氢氧化铝作用后不产生CO气体（C错，为本题正确答案），产生氧化铝，有收敛、止血和致便秘的作用（B对），长期使用可引起骨软化（D对），影响磷酸盐、四环素以及地高辛的吸收（E对）。